微球具有靶向性和缓释性的特点，但载药量较小，下列药物不宜制成微球的是
A. 阿霉素
B. 亮丙瑞林
C. 乙型肝炎疫苗
D. 生长抑素
E. 二甲双胍

正确答案：E。二甲双胍

解析：本题考查微球。二甲双胍（E错，为本题正确答案）不宜制成微球。微球是指药物溶解或者分散在高分子材料基质中形成的微小球状实体，属于基质型骨架微粒。微球具有靶向性和缓释性的特点，载药量较小。二甲双胍的载药量较大，不宜制成微球。